女，28岁。葡萄胎清宫术后阴道持续少量流血3个月。妇科检查：子宫如妊娠50天大小，质软，双侧附件均可触及囊性肿物，大小约5×4厘米，活动好。尿hCG阳性，盆腔超声示子宫肌层有一4cm×3cm不均质回声，血流信号丰富，两侧附件区有囊性低回声包块。首选的治疗为
A. 卵巢囊肿切除术
B. 放射治疗
C. 子宫病灶切除术
D. 清宫术
E. 化学治疗

正确答案：E。化学治疗

解析：患者为年轻女性，葡萄胎清宫术后阴道持续少量流血3个月（妊娠滋养细胞肿瘤在葡萄胎排空、流产或足月产后，有持续的不规则阴道流血，量多少不定）。妇科检查：子宫如妊娠50天大小，质软（常在葡萄胎排空后4～6周子宫尚未恢复到正常大小，质地偏软），双侧附件均可触及囊性肿物，大小约5×4厘米，活动好（由于hCG的持续作用，在葡萄胎排空、流产或足月产后，双侧或一侧卵巢黄素化囊肿持续存在），尿hCG阳性，盆腔超声示子宫肌层有一4×3cm不均质回声，血流信号丰富（超声检查时肌层内有回声不均匀区域或团块，边界不清且无包膜，彩色多普勒超声主要显示丰富的血流信号和低阻力型血流频谱），两侧附件区有囊性低回声包块。考虑为妊娠滋养细胞肿瘤，其包括侵蚀性葡萄胎和绒毛膜癌，患者为葡萄胎清宫术后3个月发病，故为侵蚀性葡萄胎。对于侵蚀性葡萄胎治疗原则为以化疗为主、手术和放疗为辅的综合治疗，故首选化学治疗（E对）；子宫病灶切除术（P342）（C错）主要用于切除耐药病灶，只在一些特定的情况下应用，为辅助治疗；放射治疗（P342）（B错）应用较少，主要用于肝、脑转移和肺部耐药病灶的治疗。患者已行葡萄胎清宫术，则无需再次清宫（D错）。卵巢囊肿切除术（A错）主要用于卵巢囊肿切除，但本例为卵巢黄素化囊肿，是由大量hCG持续刺激卵泡内膜细胞发生黄素化而形成的，一般无需特殊处理，可自行消失。